目前评价矽肺患者肺功能的常用指标为
A. 肺活量和时间肺活量
B. 时间肺活量、残气量和最大通气量
C. 最大通气量、潮气量和残气量
D. 肺活量、潮气量和残气量
E. 肺活量、时间肺活量和最大通气量

正确答案：E。肺活量、时间肺活量和最大通气量

解析：本题考查评价矽肺肺功能指标。随着矽肺病变进展，肺组织纤维化加重，肺弹性下降，则可出现肺活量及肺总量降低；伴肺气肿和慢性炎症时，时间肺活量降低，最大通气量减少，所以矽肺病人的肺功能以混合性通气功能障碍多见。评价矽肺患者肺功能常用的指标为肺活量、时间肺活量和最大通气量（E对ABCD错）。